汞进入人体后主要与哪个基团结合产生毒作用
A. 羟基
B. 羧基
C. 羰基
D. 巯基

正确答案：D。巯基

解析：本题考查与汞结合产生毒作用的基团。汞进入体内后，在血液内通过过氧化氢酶氧化为二价汞离子（Hg²⁺）。Hg²⁺与蛋白质的巯基（-SH）（D对ABC错）具有特殊亲和力，而巯基是细胞代谢过程中许多重要酶的活性部分，当汞与这些酶的巯基结合后，可干扰其活性甚至使其失活。